无排卵性功血正确的是
A. 子宫内膜为混合型内膜
B. 多发生在青春期和更年期
C. 出血主要取决于孕激素撤退
D. 基础体温双相
E. 产后哺乳期为最常见的发生时间

正确答案：B。多发生在青春期和更年期

解析：功血可以理解为月经失调。无排卵性功血多发生于青春期和绝经过渡期。排卵性功血多发生于生育年龄妇女，较无排卵性功血少见。有两种类型：黄体功能不足和子宫内膜不规则脱落。掌握“功能失调性子宫出血”知识点。